男，50岁。门静脉高压症食管胃底静脉曲张破裂出血，给予三腔管压迫止血及快速输血输液治疗，出血停止。此时，心率150次/分，血压90/70mmHg，中心静脉压20cmH₂O，提示该病人最可能是
A. 血容量不足
B. 肝性脑病
C. 心功能不全
D. 容量血管过度扩张
E. 容量血管过度收缩

正确答案：C。心功能不全

解析：中心静脉压代表了右心房或者胸腔段腔静脉内压力的变化，而血压反应的是主动脉血压，患者中心静脉压高（中心静脉压正常值为5～10cmH₂O），血压偏低，说明血液都淤积在右心房，而不能通过心脏做功排出，提示心功能不全（C对）或血容量相对过多。血容量不足（A错）时中心静脉压低，血压正常或偏低。容量血管过度扩张（D错）时中心静脉压低而血压正常。容量血管过度收缩（E错）时中心静脉压高而血压正常。详见表5-2 中心静脉压与补液的关系。肝性脑病（B错）主要表现为肝功能受损及意识障碍。